用于防治晕车、晕船、晕机，但青光眼、胃溃疡、妊娠、心动过速者应慎用的是
A. 盐酸异丙嗪
B. 马来酸氯苯那敏
C. 盐酸苯海拉明
D. 茶苯海明
E. 盐酸地芬尼多

正确答案：E。盐酸地芬尼多